当人群中尿碘低于多少时，发生克汀病的流行
A. 25μg/d
B. 35μg/d
C. 45μg/d
D. 55μg/d
E. 65μg/d

正确答案：A。25μg/d

解析：本题考查克汀病的流行。地方性克汀病原系指欧洲阿尔卑斯山区常见的一种体格发育落后、痴呆和聋哑的疾病。这是在碘缺乏地区出现的一种比较严重碘缺乏病的表现形式。当人群中尿碘低于25μg/d时（A对BCDE错），发生克汀病的流行。